男，45岁。因“胃溃疡”行胃部分切除术，卧床7天后出现高热，咳脓血痰伴气促。查体：T39℃，P120次/分，R30次/分。双肺可闻及少许湿啰音。痰液涂片检查可见大量脓细胞，成堆排列的G⁺球菌，白细胞内也可见G⁺球菌。最可能感染的细菌是
A. 金黄色葡萄球菌
B. D族链球菌
C. A族链球菌
D. 脑膜炎奈瑟菌
E. 肺炎链球菌

正确答案：A。金黄色葡萄球菌

解析：患者中年男性，45岁。因“胃溃疡”行胃部分切除术，卧床7天后出现高热（考虑感染），咳脓血痰伴气促（可能与吸入胃内容物有关）。查体：T39℃（36～37℃，升高提示感染），P120次/分（正常值60～100次/分，升高因发热所致），R30次/分（正常值12～20次/分，升高因发热所致）。诊断为吸入性肺炎，多为小叶性肺炎。痰液涂片检查可见大量脓细胞，成堆排列的G⁺球菌，白细胞内也可见G⁺球菌。最可能感染金黄色葡萄球菌（A对）。肺炎链球菌（E错）为革兰染色阳性球菌，多成双排列或短链排列。脑膜炎奈瑟菌（D错）是流行性脑脊膜炎的病原菌，为革兰染色阴性双球菌。A族链球菌（C错）革兰染色阳性，可引起化脓性扁桃体炎，咽炎，鼻窦炎，中耳炎及产褥热，不会引起肺部感染。D族链球菌（B错）为粪链球菌，革兰阳性多侵袭老年人，女性及身体虚弱或肿瘤患者，多见于妇科及尿道炎症。